全口义齿取模前托盘周围边缘高度应离开黏膜皱襞约
A. 1mm
B. 2mm
C. 1～2mm
D. 2～3mm
E. 3mm

正确答案：B。2mm

解析：本题考查无牙颌的印模与模型。取模前的准备：调整体位、选择托盘。上颌托盘的宽度应比上颌牙槽嵴宽2～3mm，周围边缘高度应离开黏膜皱襞约2mm（B对），唇颊系带处应呈切迹。